为了解某市慢性病的分布情况，在该市随机抽取3个城区，每个城区随机抽取2个社区，对抽取的社区内所有50岁及以上的中老年人进行调查。该调查可计算
A. 发病专率
B. 罹患率
C. 患病率
D. 存活率
E. 发病率

正确答案：C。患病率